美国一女性患者，患有严重的脑综合征、压疮、心脏病、糖尿病等，对环境没有感觉，只有原始的脑功能，有自主呼吸，没有认识、行为能力，且无改善的希望，住院不久即插入鼻饲管以维持生命。她的监护人要求取走鼻饲管，被主管医师拒绝，监护人向法院起诉要求强迫取走，法院同意并下令取走：但受理上诉的法院否定了这个决定，认为中止喂饲就是杀人。3年后，女患者死亡，她的鼻饲管仍保留着。对主管医师行为的正确伦理评价是
A. 完全正确
B. 完全错误
C. 基本上错误，侵犯了患者家属自主权
D. 基本上正确，但应弄清患者本人意愿，彻底维护患者权益
E. 以上都不是

正确答案：D。基本上正确，但应弄清患者本人意愿，彻底维护患者权益